目前仍在探索的腹腔镜手术不包括
A. 胃切除术
B. Whipple手术
C. 门静脉转流术
D. 门静脉断流术
E. 解剖性肝切除术

正确答案：A。胃切除术

解析：腔镜手术目前普遍开展的手术包括胃癌根治切除术，所以目前仍在探索的腹腔镜手术不包括胃切除术（A错，为本题正确答案）。腹腔镜手术目前仍在探索的手术为胰十二指肠切除（Whipple）手术（B对）、解剖性肝切除术（E对）、血管动脉瘤切除或转流术等。腹腔镜手术目前普遍开展的手术为胆囊切除术、腹腔镜诊断术、食管癌、胃癌、结肠、直肠根治切除术、阑尾切除术、食管反流手术（Nissen手术）、小肠切除术、疝修补术、脾切除术、肾上腺切除术、淋巴结清扫术、肝叶切除术（肿瘤）、胰腺尾部切除术、胆囊空肠吻合术、胃十二指肠溃疡手术等。肝前性门脉高压通常采取转流手术，是将门脉系和腔静脉系连通起来，使压力较高的门脉系血直接分流到腔静脉系去（C对）。肝后性门脉高压，通常采取断流手术（脾切除）以及肠系膜上静脉和下腔静脉（D对）。